下列滤器或滤材中，可用于注射剂除菌过滤的是
A. 微孔滤膜
B. 砂滤棒
C. 石棉板
D. 板框压滤机
E. 压滤器

正确答案：A。微孔滤膜

解析：本题考查微孔滤膜的应用。微孔滤膜（A对）是利用高分子化学材料，致孔添加剂经特殊处理后涂抹在支撑层上制作而成，被广泛应用于科研、食品检测、化工、纳米技术、能源和环保等众多领域。